关于种植体牙周病变的病因错误的是
A. 吸烟
B. 长期服用药物
C. 菌斑聚集
D. 咬合负载重
E. 全身系统性疾病

正确答案：B。长期服用药物

解析：目前认为种植体周围组织病变的主要致病因素是种植体上的菌斑微生物和负载过重，此外，其他的一些因素也对种植体周围病变的发生起到促进作用。如牙周炎病史、种植义齿类型、种植体表面、手术技术和术后处理、骨的质和量、软组织附着类型、生物学宽度、种植体的深度、龈瓣的设计等也与种植体周围组织疾病的发生发展有一定关系、吸烟、酗酒、患者的全身健康状况（糖尿病等全身系统性疾病等）。掌握“种植体周围组织疾病”知识点。